男，35岁，消瘦乏力怕热手颤二个月，夜间突然出现双下肢软瘫，急诊查：神志清，血压140／80mmHg，心率108次／分，律齐，甲状腺轻度增大无血管杂音。导致病人双下肢软瘫的直接原因可能是
A. 脑栓塞
B. 运动神经元病
C. 重症肌无力
D. 呼吸性碱中毒
E. 血钾异常

正确答案：E。血钾异常

解析：青年男性患者，消瘦、乏力、怕热、手颤二个月（甲状腺功能亢进症典型症状），脉压差增大、甲状腺轻度增大无血管杂音（甲状腺功能亢进症典型体征），夜间突然出现双下肢软瘫（低钾性周期性瘫痪典型表现），考虑诊断为甲状腺功能亢进并发低钾性周期性瘫痪。甲亢时，过多的甲状腺素可增强细胞膜上钠钾泵活性，促进K⁺向细胞内转移，引起血钾降低，可表现为双下肢肌无力，腱反射减退等，称为甲状腺毒症性周期性瘫痪。因此导致其出现双下肢软瘫的直接原因为血钾异常（E对）。脑栓塞（八版神经病学P185）（A错）多急骤发病，出现偏瘫、失语等局灶性神经功能缺损，既往有栓子来源的基础疾病，如心脏病、严重的骨折等病史。运动神经元病（八版神经病学P214）（B错）通常起病隐匿，缓慢进展，表现为肌无力、肌萎缩和锥体束征的不同组合。重症肌无力（八版神经病学P366）（C错）表现为呈“晨轻暮重”的肌无力，全身骨骼肌均可受累，多以脑神经支配的肌肉最先受累。首发症状常为一侧或双侧眼外肌麻痹，四肢肌肉受累以近端无力为重，表现为梳头、上楼梯困难。呼吸性碱中毒（P780）（D错）主要表现为换气过度和呼吸加快，表现为神经肌肉兴奋性增高，急性轻者可有口唇、四肢发麻、刺痛，肌肉颤动；重者有眩晕、晕厥、视力模糊。